注射剂的质量要求不包括
A. 无菌
B. 无热原
C. 无色
D. 渗透压与血浆的渗透压相等或接近
E. pH值与血液相等或接近

正确答案：C。无色